男，30岁。低热、腹痛、腹胀2个月，体温最高38℃，一般发生在下午。2个月来体重减轻5kg。查体：腹部压痛，右下腹可触及边界不清、质地柔韧的包块，移动性浊音（＋）。腹腔穿刺抽出暗黄色浑浊液体。腹水化验：比重1.026，蛋白31g/L，白细胞710×10⁹/L，单个核细胞0.85。适当的治疗措施是
A. 抗结核治疗
B. 腹腔探查术
C. 静脉应用广谱抗生素
D. 静脉应用免疫抑制剂
E. 腹腔灌洗

正确答案：A。抗结核治疗

解析：腹水化验：暗黄色浑浊液体，比重1.026，蛋白31g/L，白细胞710×10⁹/L，为渗出液。患者午后低热，体重减轻，以单个核细胞为主，诊断为结核性腹水。因此适当的治疗措施是抗结核治疗（A对）。